胚胎期缺乏可引起克汀病的是
A. 碘
B. 叶酸
C. 维生素A
D. 硫胺素
E. 烟酸

正确答案：A。碘